适宜睡前服用，用于抑制“酸突破现象”的抑酸剂是
A. 雷尼替丁
B. 乳酸菌素
C. 前列地尔
D. 泮托拉唑
E. 铝碳酸镁

正确答案：A。雷尼替丁

解析：本题考查抑酸剂。服用质子泵抑制剂（如奥美拉唑）后，夜间会有超过1个小时的时间出现胃内pH小于4.0，称为夜间酸突破现象，雷尼替丁可以抑制胃酸分泌,能够抑制奥美拉唑的酸突破现象。